关于男性左肾的位置正确的是
A. 为腹膜内位器官。
B. 肾门约在第2腰椎椎体平面
C. 上端平第12胸椎上缘
D. 下端平第3腰椎
E. 低于右肾

正确答案：C。上端平第12胸椎上缘

解析：肾位于脊柱两侧，腹膜后间隙内，为腹膜外位器官（A错）。左肾在第 11 胸椎椎体下缘至第 2-3 腰椎椎间盘（D错）之间，即上端平第12胸椎上缘（C对）。肾门约在第1腰椎椎体平面（B错）。因受肝的挤压，右肾低于左肾约 I -2cm（E错）。